患儿，男，1岁。腹痛、哭闹、呕吐，伴果酱样血便3天，发热1天。查体：面色苍白，出汗，腹肌紧张，有压痛和反跳痛，脐右上方扣及腊肠形肿块，右下腹空虚。最佳的处理是
A. 空气灌肠
B. 钡剂灌肠
C. 结肠镜检查
D. 急诊手术
E. 抗感染治疗

正确答案：D。急诊手术

解析：男性患儿，腹痛、呕吐、发热伴果酱样血便3天，脐右上方扣及腊肠形肿块，右下腹空虚，应考虑为肠套叠。患儿病程已超过48小时，并且出现腹膜刺激征，提示有肠管坏死，因此应急诊手术（D对），切除坏死肠段。空气灌肠（A错）及钡剂灌肠（B错）为肠套叠的常用诊断方法，也是回盲型或结肠型肠套叠的早期治疗方法。结肠镜检查（C错）对结肠型肠套叠有一定的诊断价值，对肠套叠的治疗意义不大。抗感染治疗（E错）为一般辅助治疗措施。手术指征1.肠套叠不能复位 2.超过48小时 3.出现腹膜刺激征 4.一般情况恶化 5.怀疑肠道坏死